男孩，12岁，诊断为左胫骨近端骨髓炎，经局部引流后症状好转，但目前局部仍有窦道流脓。X线检查显示有大块死骨及新生骨，有包壳形成。最主要的治疗措施是
A. 清除病灶
B. 间断应用抗生素
C. 窦道刮除术
D. 大剂量抗生素
E. 石膏固定

正确答案：A。清除病灶

解析：患儿左胫骨近端骨髓炎好转后，局部仍有窦道流脓，X线检查显示有大块死骨及新生骨，有包壳形成（提示病程迁延），结合患者病史、症状及影像学表现，应诊断为慢性骨髓炎。患者病变部位有死骨形成、窦道流脓，符合手术治疗指征（手术指证：有死骨形成，有无效腔及窦道流浓者），故目前最主要的治疗措施是及时手术清除病灶（A对）。间断应用抗生素（B错）、大剂量抗生素（D错）治疗均为慢性骨髓炎急性发作期治疗措施。患者已有死骨形成，仅行窦道刮除术（C错）不能彻底治愈。术后为防止关节挛缩畸形、病理性骨折，可用石膏进行固定（E错），但其仅为辅助治疗方法，而非该患者最主要的治疗措施。